定坤丹除滋补气血外，又能
A. 调经舒郁
B. 活血调经
C. 调经止带
D. 除烦安神
E. 理气止痛

正确答案：A。调经舒郁

解析：本题考查的是定坤丹的功能。定坤丹除滋补气血外，又能调经舒郁（A对）。定坤丹【功能】滋补气血，调经舒郁。益母草颗粒（膏、胶囊、片、口服液）【功能】活血调经（B错）。乌鸡白凤丸（片）【功能】补气养血，调经止带（C错）。更年安片（胶囊）【功能】滋阴清热，除烦安神（D错）。妇康宁片【功能】调经养血，理气止痛（E错）。